草豆蔻的功效是
A. 化湿行气，温中止泻，安胎
B. 化湿，解暑，止呕
C. 行气，燥湿，消积，平喘
D. 燥湿健脾，祛风湿
E. 燥湿行气，温中止呕

正确答案：E。燥湿行气，温中止呕

解析：草豆蔻辛温香燥，药力较强，入脾、胃经。功善燥湿、温中、行气而止呕、止泻，主治寒湿中阻、脾胃气滞之胀满、呕吐、泄泻等（E对）。化湿行气，温中止泻，安胎（A错）是砂仁的功效。行气，燥湿，消积，平喘（C错）是厚朴的功效。燥湿健脾，祛风湿（D错）是苍术的功效。燥湿行气，温中止呕（E对）是草豆蔻的功效。